不是预防小儿营养性缺铁性贫血的措施是
A. 提倡母乳喂养
B. 牛乳喂养应加热
C. 铁强化婴幼儿食品
D. 早产儿早期补铁
E. 早产儿补足维生素B₁₂

正确答案：E。早产儿补足维生素B₁₂

解析：维生素B12缺乏主要导致的是营养性巨幼细胞性贫血，因此早产儿补足维生素B12与预防小儿营养性缺铁性贫血无关（E对）。提倡母乳喂养（A错）、牛乳喂养应加热（B错）、铁强化婴幼儿食品（C错）、早产儿早期补铁（D错）都可以有效的预防小儿营养性缺铁性贫血的发生。